男，16岁。近2年来无明显原因出现与人交往减少，经常独自呆于一处，有时候会不明原因发笑。对家人漠不关心。生活越来越懒散。以前感兴趣的事情，现在也不做了。最可能的诊断是
A. 中度精神发育迟滞
B. 重性抑郁症迟滞型
C. 精神分裂症单纯型
D. 精神分裂症衰退型
E. 精神分裂症紧张型

正确答案：C。精神分裂症单纯型

解析：患者青少年男性（精神分裂症单纯型好发年龄），近2年无明显原因出现与人交往减少，经常独自呆于一处，有时会不明原因发笑，对家人漠不关心，生活越来越懒散，以前感兴趣的事情，现在不感兴趣了（患者病情进展缓慢、持续，生活懒散，对工作学习兴趣日益减少，情感淡漠，冷淡亲友等为精神分裂症单纯型典型临床表现），根据患者病史，症状等，可诊断为精神分裂症单纯型（C对）。精神分裂紧张型（E错）多起病于中青年，且主要表现为紧张性兴奋和紧张性木僵，与该患者临床症状不符。精神分裂症的临床分型中，没有精神分裂衰退型（D错）。中度精神发育迟滞（A错）主要表现为患者从幼年开始的智力和运动发育明显迟缓于正常儿童，该患者未有智力障碍的症状。重性抑郁常伴有精神病性症状，且已无工作、社交或家务活动，该患者无精神病性症状，且社交只是减少，未消失（B错）。